白及的功效是
A. 化瘀止血
B. 收敛止血
C. 凉血止血
D. 温经止血
E. 补气止血

正确答案：B。收敛止血

解析：白及甘涩质黏，苦寒清泄，入肺、肝、胃经。善收敛止血，兼益肺胃，治体内外出血，最宜肺胃损伤之咳血、吐血，以及肺痈咳吐脓血。善消肿生肌，治痈疽疮疡，初起未脓服之可消，溃久不敛敷之可愈；治烫伤、皮肤皲裂、肛裂，外用能促进创口愈合（B对）。善化瘀止血（A错）的药有三七、茜草、蒲黄等。善凉血止血（C错）的药有大蓟、小蓟、地榆、槐花。善温经止血（D错）的药有艾叶、炮姜、灶心土。